高血压病脑出血最常见的部位是
A. 豆状核和丘脑
B. 内囊和基底节
C. 蛛网膜下腔
D. 侧脑室
E. 大脑髓质

正确答案：B。内囊和基底节

解析：内囊和基底节区的豆纹动脉和旁正中动脉等深穿支动脉，自脑底部的动脉直角发出，承受较高的血流冲击，易导致血管破裂出血，因此内囊和基底节区（B对）是最常见部位高血压脑出血最常见的部位，约占高血压脑出血（ICH）的70%。豆状核和丘脑（A错）出血约占ICH的10%-15%。蛛网膜下腔（C错）并非脑出血的发病部位，蛛网膜下腔出血是指颅内血管破裂，血液流入蛛网膜下腔引起的综合症。侧脑室（D错）出血约占ICH的3%-5%。大脑髓质（E错）包括除大脑皮质以外的内囊、基底节等其他所有大脑白质部分，范围太广，不符合题意。